五脏关系中主要体现在气血方面的两脏是
A. 心与肺
B. 心与肾
C. 肺与脾
D. 脾与肾
E. 肺与肾

正确答案：A。心与肺

解析：心肺同居上焦，心主血，肺主气，心与肺的关系主要体现为气与血的关系（A对）。心主一身之血，肺主一身之气，两者相互协调，保证气血的正常运行，维持机体各脏腑组织的生理功能。心主血脉，而肺朝百脉，助心行血，是血液正常运行的必要条件；肺司呼吸功能的正常发挥也有赖于心主血脉。由于宗气具有贯心脉行血气、走息道行呼吸的生理功能，因此，积于胸中的宗气是联系心搏动和肺呼吸的中心环节。心与肾的关系，主要表现为水火既济、精神互用、君相安位等方面（B错）。肺与脾的关系，主要表现在气的生成与津液代谢两个方面（C错）。脾与肾的关系，主要表现在先天后天相互资生与津液代谢方面（D错）。肺与肾的关系，主要表现在呼吸运动、津液代谢及阴阳互资三个方面（E错）。